来源于肉豆蔻科植物的是
A. 砂仁
B. 豆蔻
C. 二者均是
D. 二者均不是

正确答案：D。二者均不是

解析：本题考查的是砂仁与豆蔻的来源。砂仁与豆蔻均来源于姜科（D对）。砂仁（A错）：【来源】为姜科植物阳春砂、绿壳砂、或海南砂的干燥成熟果实。豆蔻（B错）：【来源】为姜科植物白豆蔻、或爪哇白豆蔻的干燥成熟果实。